下列关于均数的标准误的叙述，错误的是
A. 是样本均数的标准差
B. 反映样本均数抽样误差大小
C. 与总体标准差成正比，与根号n成反比
D. 增加样本含量可以减少标准误
E. 其值越大，用样本均数估计总体均数的可靠性越好

正确答案：E。其值越大，用样本均数估计总体均数的可靠性越好